最大无作用剂量是
A. 一群个体中不引起死亡的最高剂量
B. 阈剂量
C. 未能观察到任何对机体损害作用的最低剂量
D. 未能观察到任何对机体损害作用的最高剂量
E. 人类终生摄入该化合物未引起任何损害作用的剂量

正确答案：D。未能观察到任何对机体损害作用的最高剂量